大连接体舌杆边缘圆滑，上缘厚约为
A. 0.5mm
B. 1mm
C. 1.5mm
D. 2mm
E. 3mm

正确答案：B。1mm

解析：本题考查局部义齿连接体。舌杆：位于下颌舌侧龈缘与舌系带或口底黏膜皱襞之间。舌杆纵剖面呈半梨形，边缘圆滑，上缘薄（1mm）（B对）而下缘厚（2mm），上缘离开牙龈缘至少3～4mm。